男，40岁。患十二指肠球部溃疡穿孔，急症上腹正中切口行胃大部切除术，并置切口内乳胶片引流。正常情况下，该患者拆线时间应为术后
A. 5～6天
B. 10～12天
C. 12天以上
D. 7～9天
E. 3～4天

正确答案：D。7～9天

解析：一般头、面、颈部在术后4-5日拆线，下腹部、会阴部在术后6-7日拆线，胸部、上腹部、背部、臀部手术7-9日拆线，四肢手术10-12日拆线（近关节处可适当延长），减张缝线14日拆线。该患者属上腹部手术，选7-9日（D对）拆线。